佝偻病激期（活动期）的血生化变化是
A. 血钙稍降低，血磷明显降低，钙磷乘积降低，碱性磷酸酶明显升高
B. 血钙升高，血磷降低，钙磷乘积降低，碱性磷酸酶升高
C. 血钙降低，血磷升高，钙磷乘积降低，碱性磷酸酶升高
D. 血钙降低，血磷降低，钙磷乘积升高，碱性磷酸酶降低
E. 血钙降低，血磷降低，钙磷乘积升高，碱性磷酸酶升高

正确答案：A。血钙稍降低，血磷明显降低，钙磷乘积降低，碱性磷酸酶明显升高

解析：佝偻病活动期（激期）除初期症状外，主要表现为骨骼改变和运动功能发育迟缓。骨骼改变往往在生长最快的部位最明显，故不同年龄有不同的骨骼表现。血生化及骨骼X线改变：血钙稍降低，血磷明显降低，钙磷乘积常低于30，碱性磷酸酶明显增高。掌握“维生素D缺乏性佝偻病”知识点。